白芍不具有的功效是
A. 养血
B. 润肺
C. 敛阴
D. 柔肝止痛
E. 平抑肝阳

正确答案：B。润肺

解析：本题考查白芍的功效。白芍不具有的功效是润肺（B错，为本题正确答案）。白芍【功效】养血（A对）调经，敛阴（C对）止汗，柔肝止痛（D对），平抑肝阳（E对）。